在描述神经系统发育特点中，以下哪一项描述是错误的
A. 神经系统发育是一次性形成的
B. 只有一次生长突增高峰
C. 出生时，新生儿的脑重平均为370g，占其身体的10%～12%
D. 新生儿的脑重已是成人脑重的25%，6岁接近成人的脑重的85%~90%
E. 脑神经在12岁左右几乎完全髓鞘化

正确答案：E。脑神经在12岁左右几乎完全髓鞘化

解析：本题考查神经系统的相关内容。1.5周岁（E错，为本题正确答案）时脑神经基本完成髓鞘化。人体器官系统在由胎儿期发育至成熟的过程中，神经系统发育是一次性形成的（A对）且仅存在一次生长突增高峰（B对）；新生儿的大脑重量平均为370克占身体的10%～12%（C对），其是成人脑重的25%，1岁时婴儿的大脑重量是成人脑重的60%，6岁是接近成人脑重的85%～90%（D对）。